男孩，5岁，排尿困难，尿流中断，跑动或改变体位姿势后又可排尿。最可能的疾病是
A. 尿道狭窄
B. 神经源性膀胱
C. 前尿道结石
D. 尿道瓣膜
E. 膀胱结石

正确答案：E。膀胱结石

解析：男性患儿，排尿困难、尿流中断，跑动或改变体位姿势后又可排尿（膀胱结石的典型表现），依据患儿的临床表现，最可能的疾病是膀胱结石（E对）。尿道狭窄（A错）主要表现为排尿困难，多有尿道外伤或尿道感染史。神经源性膀胱（B错）属动力性梗阻，常表现为排尿困难、残余尿量较多、肾积水和肾功能不全，一般不会出现尿流中断。前尿道结石（C错）典型表现为排尿困难、点滴状排尿，伴尿痛，跑动或改变体位姿势后症状多不能缓解。尿道瓣膜（D错）分为前尿道瓣膜和后尿道瓣膜，前尿道瓣膜常表现为排尿困难、膀胱内大量残余尿；后尿道瓣膜常表现为尿线无力、排尿中断、淋漓不尽。